冻疮的命名方法是
A. 以病因命名
B. 以部位命名
C. 以疾病特征命名
D. 以形态命名
E. 以范围大小命名

正确答案：A。以病因命名

解析：本题考查疾病的命名原则。冻疮是人体遭受寒邪侵袭所引起的局部性或全身性损伤，其发病原因只要是寒冷，故命名为冻疮，是以病因命名的（A对）。以部位命名的有乳痈、子痈、对口疽等（B错）。以疾病特征命名的有烂疔、流注、湿疮等（C错）。以形态命名的有蛇头疔、鹅掌风等（D错）。以范围命名的有，如小者为疖，大者为痈等（E错）。